对于急性中毒的儿童的急救措施不包括
A. 尽快清除未被吸收的毒物
B. 对症治疗
C. 特效治疗
D. 防止毒物吸收
E. 抗感染治疗

正确答案：E。抗感染治疗

解析：本题考查儿童急性中毒的急救措施。抗感染治疗（E错，为本题正确答案）是针对病原体的治疗，主要是破坏病原体；致病的病原体有病毒、细菌、真菌、螺旋体等。急性中毒儿童的急救措施包括：①尽快清除未被吸收的毒物（A对）：对接触中毒者应立即清洗局部；对吸入中毒者应要求立即脱离现场，呼吸新鲜空气及吸氧；对口服中毒者，采用催吐、洗胃、灌肠；②防止毒物吸收（D对），保护皮肤、黏膜；③对症治疗（B对）：对惊厥、呼吸困难、循环衰竭等，应立即对症治疗，支持患儿度过危险，在紧急处理后立即将患儿送医院作进一步抢救，在明确诊断后尽快给以特效解毒剂进行治疗（C对）。